治肾虚作喘的药物是
A. 朱砂
B. 磁石
C. 两者均是
D. 两者均不是

正确答案：B。磁石

解析：本题考查的是磁石的主治病证。治肾虚作喘的药物是磁石（B对）。磁石：【主治病证】（1）心神不宁，心悸失眠，惊风癫痫。（2）肝阳上亢，头晕目眩。（3）耳鸣，耳聋，目昏。（4）肾虚喘促。朱砂（A错）：【主治病证】（1）心火亢盛之心神不安、胸中烦热、惊悸不眠，癫狂，癫痫。（2）疮疡，咽痛，口疮。